可以产生病因假设的流行病学研究方法不包括
A. 现况研究
B. 队列研究
C. 监测
D. 病例对照研究
E. 生态学研究

正确答案：B。队列研究

解析：本题考查可以产生病因假设的流行病学研究方法。可以产生病因假设的流行病学研究方法包括：现况研究（A对）、监测（C对）、生态学研究（E对）和病例对照研究（D对）。队列研究（B错，为本题正确答案）只可以检验假设，而不能产生假设。